男，18岁，自幼有出血倾向。出血时间延长，凝血时间正常，血小板150×10⁹/L，血小板粘附率降低，部分凝血活酶时间延长，凝血酶原时间正常。父亲也有类似病史，考虑的诊断是
A. 血友病
B. 血管性血友病
C. 过敏性紫癜
D. 维生素K缺乏
E. 遗传性出血性毛细血管扩张症

正确答案：B。血管性血友病

解析：患者青年男性，自幼有出血倾向，出血时间延长（皮肤血管的止血功能，反映了血管性和血小板性因素），血小板150×10⁹/L（正常100～300×10⁹/L）正常，血小板黏附率降低，提示血小板黏附功能降低；凝血时间（CT）正常，部分凝血活酶时间（APTT）延长（CT、APTT反映内源性凝血功能），提示内源性凝血功能异常；凝血酶原时间（PT，反映外源性凝血功能）正常；父亲也有类似病史（家族史阳性）（符合血管性血友病的特点），故该患者考虑诊断为血管性血友病（B对）。血友病（P618）（A错）以阳性家族史、幼年发病、自发或轻度外伤后出血不止、血肿形成及关节腔出血为特征，出血时间、凝血酶原时间、血小板计数、血小板聚集功能正常，APTT延长；过敏性紫癜（P613）（C错）为血管变态反应性疾病，常有皮肤紫癜，血小板计数、功能及凝血相关检查除出血时间可能延长外，其他均为正常；维生素K缺乏（D错）可导致维生素K依赖的凝血因子Ⅱ、Ⅶ、Ⅸ、Ⅹ缺乏，引起内源性和外源性凝血功能异常，凝血时间、部分凝血活酶时间、凝血酶原时间延长；遗传性出血性毛细血管扩张症（E错）是由血管壁发育异常引起的，血小板计数、凝血功能正常。